两种化学物质同时进入机体，其毒性作用超过两者之和称为
A. 相加作用
B. 协同作用
C. 独立作用
D. 拮抗作用
E. 综合作用

正确答案：B。协同作用

解析：本题考查协同作用。两种化学物质同时进入机体，其毒性作用超过两者之和称为协同作用（B对ACDE错）。